在医务人员之间人际关系的特点中，“比、学、赶、超”体现的是
A. 协作性
B. 平等性
C. 互助性
D. 竞争性
E. 同一性

正确答案：D。竞争性

解析：在医务人员之间人际关系的特点中，“比、学、赶、超”体现的是竞争性（D对）。医务人员应严守公开、公平、公正的“竞争原则”，使有序竞争和团队协作相辅相成，以期实现更好的为人民健康服务的宗旨。